牙周翻瓣手术中，最关键最常用的切口是
A. 内斜切口
B. 沟内切口
C. 牙间切口
D. 纵行切口
E. 垂直切口

正确答案：A。内斜切口

解析：本题考查牙周翻瓣手术的切口设计。牙周翻瓣手术中，最关键最常用的切口是内斜切口（A对）。牙周翻瓣手术的切口设计：1.水平切口包括以下3个步骤：（1）第一切口：为内斜切口，是翻瓣术中最关键的切口，也是目前采用最多的切口。其优点是：①将袋内壁的上皮和炎症组织切除；②保留了相对完好的袋外侧面的角化龈；③形成的龈瓣边缘薄，易于贴附牙面和骨面，愈合后牙龈外形良好。（2）第二切口：为沟内切口（B错）。将刀片从袋底切入，直达牙槽嵴顶或其附近。围绕术区牙齿的一周均做此切口，目的是将欲切除的袋壁组织与牙面分离。（3）第三切口：也称牙间切口（C错）或牙间水平切口，将龈瓣翻开后作第三切口。将刀片与牙面垂直，在骨嵴顶的冠方，水平地切断袋壁组织与骨嵴顶及牙面的连接。2.纵行切口（D错）也称垂直切口（E错），是在水平切口的近中端或近、远中两端做的纵行切口，目的是为了减小组织张力、更好地暴露术区。3.保留龈乳头切口：在植骨术或引导性组织再生术时，以及在前牙美观需要时，如果龈乳头的近远中径较宽，可将整个龈乳头保持在某一侧的龈瓣上，而不是将龈乳头从颊、舌向切开和翻起，一般将完整保留的龈乳头连在唇（颊）侧瓣上。其优点是对邻面植骨处覆盖较严密，避免植入物脱落或感染，并且可减少术后龈乳头的退缩，有利于美观。